下述何种心绞痛药为阿片受体部分激动剂
A. 纳洛酮
B. 芬太尼
C. 安那度
D. 喷他佐辛
E. 美沙酮

正确答案：D。喷他佐辛